女，30岁，阴道不规则流血20天，咳嗽5天。半年前行人工流产，吸出物见到绒毛组织，妇科检查：子宫如40天妊娠大小，质软，双侧附件区均可触及大小约5cm的囊性包块，胸部X线片示双侧中下野多发棉球状阴影。首先考虑的诊断是
A. 绒癌
B. 侵蚀性葡萄胎
C. 葡萄胎
D. 先兆流产
E. 稽留流产

正确答案：A。绒癌

解析：女性患者，半年前行人工流产，吸出物见到绒毛组织（正常妊娠），现阴道不规则流血，双侧附件区均可触及大小约5cm的囊性包块（卵巢黄素化囊肿）。患者咳嗽，胸部X线片示双侧中下野多发棉球状阴影（提示肺转移）。据患者病史、临床表现及妇科检查，最可能的诊断为1.绒癌（A对）；2.转移性肺癌。本题需要注意的是：叶状绒毛膜是胎盘的主要组成结构，半年前人工流产吸出绒毛组织提示患者正常妊娠。临床继发于流产、分娩、异位妊娠及葡萄胎1年以上均为绒癌，继发于葡萄胎半年以内为侵蚀性葡萄胎。